BP现有版本为
A. 1995
B. 1996
C. 1997
D. 1998
E. 1993

正确答案：D。1998